下列哪项不是丹毒的临床特点
A. 病起缓慢，恶寒发热
B. 局部皮肤掀热肿胀，迅速扩大
C. 局部皮肤忽然变赤
D. 好发于小腿部
E. 容易复发

正确答案：A。病起缓慢，恶寒发热

解析：丹毒是患部皮肤突然发红成片、色如涂丹的急性感染性疾病。本病发无定处，根据其发病部位的不同又有不同的病名，其特点是病起突然，恶寒发热（A对）。丹毒可见局部皮肤忽然变赤，色如丹涂脂染（C错）。表现出焮热肿胀，边界清楚，迅速扩大（B错）。丹毒挟湿热者好发于下肢小腿部（D错）。数日内可逐渐痊愈，但容易复发（E错）。